抗体在孕期或分娩期经胎盘从母体传给子代称为
A. 垂直传播
B. 遗传性传播
C. 血源性传播
D. 围产期传播
E. 日常生活接触传播

正确答案：A。垂直传播

解析：本题考查垂直传播的概念。垂直传播（A对BCDE错）是指在怀孕期间和分娩过程中，病原体或抗体通过母体直接传给子代。